在成人时腮腺导管的开口应在
A. 上颌第一乳磨牙相对的颊黏膜处
B. 上颌第二乳磨牙相对的颊黏膜处
C. 上颌第一恒磨牙相对的颊黏膜处
D. 上颌第二恒磨牙相对的颊黏膜处
E. 上颌第三恒磨牙相对的颊黏膜处

正确答案：D。上颌第二恒磨牙相对的颊黏膜处

解析：成人时在上颌第二恒磨牙相对的颊黏膜处。掌握“腮腺咬肌区、腮腺与面神经解剖关系”知识点。